女，30岁，近2个月中度发热，全身肌痛，四肢关节肿痛，口腔溃疡。尿常规示红细胞（+）/高倍视野，蛋白（++）。为缓解病情，首选的药物是
A. 抗生素
B. 糖皮质激素
C. 非甾体抗炎药
D. 镇痛药
E. 抗疟药

正确答案：B。糖皮质激素

解析：育龄女性患者（系统性红斑狼疮好发人群），出现中度发热、全身肌痛、四肢关节肿痛、口腔溃疡（系统性红斑狼疮典型表现），尿常规提示血尿、蛋白尿（系统性红斑狼疮肾损害），考虑患者最可能诊的断为系统性红斑狼疮。系统性红斑狼疮为自身免疫介导的多系统损害性疾病，因此其治疗应首先抑制免疫反应，糖皮质激素具有强大的抗炎作用及抑制免疫作用，作为治疗多种自身免疫性疾病的一线用药，因此本例治疗应首选糖皮质激素（B对）。抗生素（A错）用于细菌感染性疾病的治疗。非甾体抗炎药（C错）主要作为对症治疗。镇痛药（D错）镇痛效果显著，一般不用于关节肌肉疼痛治疗。抗疟药（E错）可用于系统性红斑狼疮的治疗，但不是首选药物。